以下能够说明某一事物内部各组成部分所占比重或分布的指标是
A. 率
B. 构成比
C. 相对比
D. 中位数
E. 极差

正确答案：B。构成比

解析：构成比又称构成指标，说明某一事物内部各组成部分所占比重或分布。掌握“分类资料的统计描述与推断”知识点。